提示体内乙型肝炎病毒处于复制状态的抗体是
A. 抗-HBs
B. 抗-HBc IgM
C. 抗-HBc IgG
D. 抗-HBe
E. 抗-HDV

正确答案：B。抗-HBc IgM

解析：提示体内乙型肝炎病毒处于复制状态的抗体是抗-HBcIgM（B对），抗HBcIgM阳性提示急性期或慢性肝炎急性发作，抗HBcIgG（C错）出现较迟，但可保持多年甚至终身。乙型肝炎的保护性抗体是抗-HBs（A错）抗HBs表示对HBV有免疫力，见于乙型肝炎恢复期、既往感染及乙肝疫苗接种后。抗HBe（D错）阳性提示病毒复制多处于静止状态，传染性降低。抗-HDV（E错）是丁型肝炎病毒抗体，与乙型肝炎无关，不能提示体内乙型肝炎病毒处于复制状态。